给药个体化的步骤不包括
A. 明确诊断
B. 确定初始给药方案
C. 适时调整剂量
D. 测定血药浓度和观察临床效果
E. 药物稳定性实验

正确答案：E。药物稳定性实验

解析：本题考查个体化给药。药物稳定性实验（E错，为本题正确答案）与给药个体化步骤无关。给药个体化步骤：①根据诊断结果（A错）及患者的身体状况等具体因素，选择适合的药物及给药途径；②由临床药师跟临床医师一起拟订给药方案（B错）；③按初始方案用药；④随时观察临床效果，同时按一定时间采取血样标本（D错），测定血药浓度（D错），由血药浓度-时间的数据，求出患者的药动学参数；根据具体情况，可重复上述过程，反复调整给药方案（C错）。